下列关于休克病人预防急性肾衰竭的措施，不正确的是
A. 及时纠正低血容量性休克，避免肾缺血
B. 矫正休克时不宜使用易引起肾血管收缩的药物
C. 对有溶血倾向的病人应保持肾小管通畅，碱化尿液，避免肾小管损害
D. 休克合并DIC时，要及时应用肝素治疗
E. 病人主要出现尿量减少时，要及时使用利尿剂

正确答案：E。病人主要出现尿量减少时，要及时使用利尿剂

解析：本题考查休克病人预防急性肾衰竭的措施。关于休克病人预防急性肾衰竭的措施不正确的是病人主要出现尿量减少时，要及时使用利尿剂（E错，为本题的正确答案）。休克病人预防急性肾衰竭的措施包括：及时纠正低血容量性休克，避免肾缺血（A对）；矫正休克时不宜使用易引起肾血管收缩的药物（B对）；对有溶血倾向的病人应保持肾小管通畅，碱化尿液，避免肾小管损害（C对）；休克合并DIC时，要及时应用肝素治疗（D对）；病人主要出现尿量减少时，要及时补充血容量，而不是使用利尿剂，以避免进一步加重肾脏损害。